治疗原发性三叉神经痛首选的药物是
A. 托吡酯
B. 卡马西平
C. 乙琥胺
D. 左乙拉西坦
E. 氯硝西泮

正确答案：B。卡马西平

解析：三叉神经痛是原发性三叉神经痛的简称，表现为三叉神经分布区内短暂的反复发作性剧痛。临床首选药物治疗，卡马西平（B对）有效率高，常作为首选。托吡酯（A错）为抗癫痫药，也可以用于预防偏头痛的发作（P315）。乙琥胺（C错）用于治疗癫痫失神发作（P315）。左乙拉西坦（D错）用于治疗婴儿重症肌阵挛性癫痫（P315）。氯硝西泮（E错）是肌阵挛-失张力发作性癫痫的首选药物（P315）。